不属于一般突发环境污染事件（Ⅳ级）的构成条件的是
A. 发生3人以下死亡
B. 发生5人以下死亡
C. 4、5类放射源丢失、被盗或失控
D. 造成跨县（市）级行政区域纠纷
E. 引起一般群体性影响

正确答案：B。发生5人以下死亡

解析：本题考查一般突发环境污染事件（Ⅳ级）的构成条件。凡符合下列情形之一者，可定为一般突发环境污染事件（Ⅳ级）：1.发生3人（A对）以下死亡（B错，为本题正确答案）；2.因环境污染造成跨县级行政区域纠纷（D对），引起一般群体性影响的（E对）；3.4、5类放射源丢失、被盗或失控（C对）。